需要避光保存的药品是
A. 二甲双胍片
B. 过氧化氢溶液
C. 多酶片
D. 双氯芬酸钠
E. 硫酸镁注射液

正确答案：B。过氧化氢溶液

解析：本题考查易受光线、湿度、温度影响而变质的药品。过氧化氢溶液（B对）易受光线影响而变质，注意避光。多酶片（C错）易受环境温度影响而变质。硫酸镁注射液（E错）易风化。